某一风湿热患者，服用阿司匹林半个月突然出现呕血，首先应考虑为
A. 消化性溃疡
B. 急性胃黏膜病变
C. 肝硬化食管胃底静脉曲张
D. 十二指肠炎
E. 慢性胃炎

正确答案：A。消化性溃疡

解析：消化性溃疡常见病因为长期或大量服用非甾体类抗炎药。本例风湿热患者服用阿司匹林半月后出现呕血，首先应考虑为NSAIDs导致的消化性溃疡（A对）。急性胃黏膜病变（B错）起病骤然，突然呕血、黑粪，常出现在应激性病变之后数小时或数日；肝硬化食管胃底静脉曲张（C错），破裂导致呕血、柏油样便，病势较危急，是肝硬化致死原因，但本例患者无相关肝硬化病史，故不考虑为肝硬化。十二指肠炎（D错）主要表现为上腹部疼痛、恶心、呕吐，常伴有其他消化不良症状，如腹胀、嗳气、反酸等。少数患者可发生反复黑便或呕吐咖啡样液，但多自动止血。慢性胃炎（E错）患者有胃炎病史，缺乏特异性症状，大多数病人常无症状或有程度不同的消化不良症状，如上腹隐痛、食欲减退、餐后饱胀、反酸等。